具有磺酰脲结构，通过促进胰岛素分泌发挥降血糖作用的药物有
A. 格列本脲
B. 格列吡嗪
C. 格列齐特
D. 那格列奈
E. 米格列奈

正确答案：A、B、C。格列本脲；格列吡嗪；格列齐特

解析：本题考查磺酰脲类胰岛素分泌促进剂类降糖药。格列本脲（A对）、格列吡嗪（B对）、格列齐特（C对）均为胰岛素分泌促进剂，具有磺酰脲结构，并通过促进胰岛素分泌发挥降血糖作用。那格列奈（D错）、米格列奈（E错）属于非磺酰脲类胰岛素分泌促进剂，无磺酰脲结构。